患者，男性，35岁。上唇部肿胀疼痛3天，伴发热症状，肿胀的唇部皮肤与黏膜上出现多数的黄白色脓头，破溃后溢出脓血样分泌物，病变区呈紫红色，体温38.5℃。此病变最易引起全身并发症的原因为
A. 病原菌毒力较强
B. 此部位静脉常无瓣膜
C. 颜面表情肌的运动
D. 颜面部血液循环丰富
E. 以上均是

正确答案：E。以上均是

解析：本题考查面部疖痈。在口腔颌面部感染中面部疖痈最易发生全身并发症。这是由于疖痈的病原菌毒力较强（A对），上唇与鼻部“危险三角区”内的静脉又常无瓣膜（B对），颜面部血液循环丰富（D对），颜面表情肌和唇部的生理性运动（C对）易使感染扩散等因素所致。综上所述，以上均是（E对，为本题正确答案）此病变最易引起全身并发症的原因。